具有抑制偏寒多静等特征的体质为
A. 阴阳平和质
B. 偏阳质
C. 偏阴质
D. 阴虚质
E. 气虚质

正确答案：C。偏阴质

解析：偏阴质是具有抑制、喜静、偏寒特征的体质类型（C对）。阴阳平和质是功能较为协调的体质类型（A错）。偏阳质是具有兴奋、好动、偏热特征的体质类型（B错）。阴虚质的总体特征是阴液亏少，以口燥咽干、手足心热、等虚热表现为主要特征；心理特征为性情急躁，外向好动，活泼（D错）。气虚质的总体特征是元气不足，以疲乏、气短、自汗等气虚表现为主要特征；心理特征为性格内向，不喜冒险（E错）。